下列各项，不属关格病因的是
A. 水肿
B. 淋证
C. 癃闭
D. 消渴
E. 痰饮

正确答案：E。痰饮

解析：关格的病因有水肿（A对）、淋证（B对）、癃闭（C对），消渴虽以阴虚为本，但由于阴阳互根，消渴日久，阴损及阳，会导致脾肾阳衰，进而引起关格（D对）。